内因性抑郁和更年期抑郁患者宜选用
A. 帕罗西汀
B. 阿米替林
C. 度洛西汀
D. 文拉法辛
E. 吗氯贝胺

正确答案：B。阿米替林

解析：本题考查抑郁症的药物治疗。阿米替林（B对）对内因性抑郁和更年期的抑郁症疗效好，对反应性抑郁症及神经官能团症的抑郁状态也有效。